下列哪一项不属于细胞免疫效应
A. 抗肿瘤
B. 抗病毒
C. 引起同种移植物的排斥
D. 发生ADCC
E. 引起DTH

正确答案：D。发生ADCC